肠伤寒坏死灶的主要部位是
A. 黏膜下层
B. 皱襞内
C. 淋巴组织内
D. 黏膜层
E. 毛细血管内

正确答案：C。淋巴组织内

解析：肠伤寒是由伤寒杆菌引起的急性传染病，当感染菌量较大时，伤寒杆菌可以进入小肠，穿过小肠黏膜上皮细胞侵入肠壁淋巴组织，尤其是回肠末端的集合淋巴小结或孤立淋巴小结，故伤寒杆菌引起的坏死灶主要在淋巴组织（C对）内。